患者，男，50岁，因病毒感染而致不能闭眼，医生检查时发现其角膜反射消失。其损伤的神经可能是
A. 眼神经
B. 动眼神经
C. 三叉神经
D. 眶上神经
E. 面神经

正确答案：E。面神经

解析：一般认为，由于骨性面神经管只能容纳面神经，所以各种原因如受寒着凉、病毒感染（患者为病毒感染引起症状）、自主神经功能不稳定等导致局部神经营养血管收缩缺血，而毛细血管扩张，使得面神经水肿受压而引发本病（E对）。眼神经为三叉神经的分支，为感觉神经（A错）。动眼神经麻痹时，出现上眼睑下垂，眼球向内、向上及向下活动受限而出现外斜视和复视，并有瞳孔散大，调节和聚合反射消失（B错）。三叉神经痛表现为在人体的头面部三叉神经分布区域内，发病骤发，闪电样、烧灼样、难以忍受的剧烈性疼痛（C错）。眶上神经痛表现为起病多急性，一侧或两侧前额部阵发性或持续性针刺样痛或烧灼感，也可在持续痛时伴阵发性加剧，查体可见眶上神经出口处眶上切迹有压痛，眶上神经分布区（前额部）呈片状痛觉过敏或减退（D错）。